男，52岁。近2个月来排便次数增多，有肛门坠胀感及排便不尽感粪便变细，常有粘液血便，直肠指检发现肿块，体重下降。若经病理检查证实为直肠腺癌，肿瘤下缘距肛门约10cm，肿块直径约4cm。最佳手术方式应选择
A. Miles手术
B. 乙状结肠造口术
C. Hartmann手术
D. Dixon手术
E. 局部切除

正确答案：D。Dixon手术

解析：患者老年男性，近2个月来排便次数增多，有肛门坠胀感及排便不尽感（直肠刺激症状）粪便变细（提示肠腔狭窄），常有粘液血便（提示癌肿破溃出血），直肠指检发现肿块（60%~70%的直肠癌能在指诊时触及），体重下降（提示消耗性疾病），综上考虑诊断为直肠癌。肛管上至齿状线，下至肛门缘，长约1.5～2cm，患者肿瘤下缘距肛门约10cm，距齿状线5cm以上，适用Dixon手术（D对）。Mils手术（A错）适用于距肛门5cm内的直肠癌。乙状结肠造口术（B错）主要适用直肠癌合并肠梗阻的一期急诊处理。Hartmann手术（C错）适用于因全身一般情况差不能耐受Mils手术或者急性梗阻不宜行Dixon手术的直肠癌病人。局部切除（E错）适用于早期瘤体小、T1、分化程度高的直肠癌。